下列除哪项外，均为母乳喂养的优点
A. 营养成份丰富
B. 不需添加辅食
C. 清洁不易污染
D. 适合婴儿消化吸收
E. 增加婴儿抗病能力

正确答案：B。不需添加辅食

解析：生后6个月之内以母乳为主要食品者，称为母乳喂养，应大力提倡母乳喂养，无论母乳喂养、人工喂养或混合喂养的婴儿，都应按时于一定月龄添加辅助食品，才可满足小儿成长需求（B对）。母乳营养丰富，最适合婴儿的生理需要（A错）。母乳直接由母亲哺乳给婴儿，不需与外界接触，清洁不易污染（C错）。母乳所含成分与婴儿消化能力相适应，适合婴儿消化吸收（D错）。初乳中含较多免疫球蛋白，可增加婴儿抗病能力（E错）。